男，32岁。左下肢肿胀、发紫、剧痛2小时。1天前用粪便在农田施肥，伤及左足，半夜感胀裂样痛，症状加重，左下肢肿胀，皮肤由紫红变成紫黑色、水肿有水泡。查体：局部失去弹性，皮下有捻发音，伤口处有恶臭的血性浆液滲出。该致病菌产生的酶中，毒性最强的是
A. 胶原酶
B. 卵磷脂酶
C. 透明质酸酶
D. DNA酶
E. RNA酶

正确答案：B。卵磷脂酶

解析：32岁男性，1天前用粪便在农田施肥，伤及左足（有土壤和粪便接触史），半夜感胀裂样痛，症状加重，左下肢肿胀，皮肤由紫红变成紫黑色、水肿有水泡（受伤组织胀痛剧烈，水气夹杂），查体局部失去弹性，皮下有捻发音（气性坏疽典型体征），伤口处有恶臭的血性浆液滲出（组织坏死严重），结合患者既往史、临床表现和体征，可诊断为气性坏疽，致病菌为产气荚膜梭菌。产气荚膜梭菌可产生多种外毒素，其中以卵磷脂酶（α毒素）（B对）毒性最强最重要。胶原酶（A错）、透明质酸酶（C错）、DNA酶（D错）都为产气荚膜梭菌的次要酶（P135表12-1）。RNA酶（E错）是可将RNA水解成小分子组成的核酸酶，不属于毒素。